关于男性尿道的说法，错误的是
A. 有排尿和排精功能
B. 有三个狭窄
C. 自然悬垂时有两个弯曲
D. 平均长16～22厘米
E. 两个弯曲是耻骨上弯和耻骨下弯

正确答案：E。两个弯曲是耻骨上弯和耻骨下弯

解析：男性尿道兼有排尿和排精功能（A对），起自膀胱尿道内口，止于阴茎头的尿道外口，成人尿道平均长16～22厘米（D对），分为前列腺部、膜部和海绵体部。男性尿道有三个狭窄（B对）、三个膨大和两个弯曲。三个狭窄分别为尿道内口、尿道膜部和尿道外口。三个膨大分别是尿道前列腺部、尿道球部和舟状窝。自然悬垂时有两个弯曲（C对），即耻骨下弯和耻骨前弯（E错，为本题正确答案）。